队列研究中调查对象应选择
A. 在有该病者中，选择有、无某种暴露因素的两个组
B. 在有该病者中，选择有某种暴露因素的为一组，在无该病者中选择无某种暴露因素的为另一组
C. 在无该病者中，选择有某种暴露因素的为一组，在有该病者中选择无某种暴露因素的为另一组
D. 在无该病者中，选择有、无某种暴露因素
E. 任选有无暴露的两个组

正确答案：D。在无该病者中，选择有、无某种暴露因素

解析：本题考查队列研究的概念。队列研究是将人群按是否暴露于某可疑因素及其暴露程度分为不同组，追踪其各组的结局，比较不同组之间结局频率的差异（D对ABCE错），从而判定暴露因素与结局之间有无因果关联及关联大小的一种观察性研究方法。